梅－罗氏综合征的临床表现为
A. 裂纹舌、口角炎、腺性唇炎
B. 裂纹舌、面瘫、肉芽肿性唇炎
C. 地图舌、口角炎、贫血
D. 地图舌、面瘫、贫血
E. 舌乳头炎、面瘫、肉芽肿性唇炎

正确答案：B。裂纹舌、面瘫、肉芽肿性唇炎

解析：本题考查梅－罗氏综合征。梅－罗氏综合征的临床表现为复发性口面部肿胀、复发性面瘫、裂舌三联症为临床特征，肉芽肿性唇炎是其表现之一（B对）。复发性口面部肿胀为最常见的临床表现，可表现为唇、颊、牙龈、舌、鼻部、眼睑等部位的肿胀，但以唇部肿为主，且上下唇均可受累。复发性周围性面瘫以突然发病为特征，面瘫常为单侧，也可双侧受累，可自发性消失，有间歇性，继而成永久性。裂舌舌背面出现深沟，沿主线向周围任何方向放射状排列，舌体可肿大，可由深沟中的细菌、真菌引发的慢性感染引起，舌部可出现味觉异常或味觉减退。